中毒型细菌性痢疾多见于
A. 低出生体重儿
B. 3～6个月体格健壮的婴幼儿
C. 2～7岁体格健壮的小儿
D. 8～10岁营养状况较差的儿童
E. 12～14岁儿童

正确答案：C。2～7岁体格健壮的小儿

解析：中毒型细菌性痢疾多见于2～7岁体格健壮的小儿（C对）。